低位小肠梗阻的临床特点应为
A. 腹胀，呕吐明显，可以吐粪，排便、排气停止
B. 以腹胀、呕吐不明显，无排便排气停止
C. 无呕吐，排便排气停止为著，腹痛减轻，无腹胀
D. 有腹痛、呕吐及排便、排气停止，无腹胀
E. 以腹痛和腹胀为主，无呕吐，无排气，排便停止

正确答案：A。腹胀，呕吐明显，可以吐粪，排便、排气停止

解析：低位小肠梗阻是发生在回肠下段和结肠的梗阻，腹胀症状典型，呕吐明显，可以吐粪，排便、排气停止（A对）。低位小肠梗阻的特点是腹胀明显（BD错），呕吐出现晚而次数少，并可吐出粪样物（CE错）。